静脉给与治疗剂量时，可使心率明显加快，收缩压上升，但舒张压下降，总外周阴力下降的药物是
A. 去甲肾上腺素
B. 异丙肾上腺素
C. 肾上腺素
D. 去氧肾上腺素
E. 多巴胺

正确答案：B。异丙肾上腺素